与机体阳气不足关系最密切的脏腑是
A. 肝与脾
B. 肝与肾
C. 心与肾
D. 心与脾
E. 脾与肾

正确答案：E。脾与肾

解析：肾阳为一身阳气之本，“五脏之阳气，非此不能发”。脾与肾为后天与先天，能够相互资生，相互促进。脾阳与肾阳可相互资生，相互影响。故脾阳也与一身阳气有关。（E对）。肝与脾（A错）的关系主要体现疏泄与运化的相互为用、藏血与统血的相互协调。肝与肾的关系（B错），主要表现在肝肾同源，包括精血同源、藏泄互用以及阴阳互滋互制。心与肾（C错）的关系主要表现在心肾相交，包括水火既济、精神互用，君相安位等。心与脾（D错）的关系主要表现在血液生成与运行上的相互为用、相互协同。